患者女性，28岁。停经43天，阴道少量流血2天，突感下腹部剧痛，伴肛门坠胀，恶心呕吐。查体：面色苍白，BP80/40mmHg，后穹隆穿刺抽出不凝血5ml，诊断为异位妊娠，出血性休克。最佳处理是
A. 纠正休克同时手术
B. 待血压正常手术
C. 保守治疗
D. 静脉输液，输血
E. 自体输血及抗感染治疗

正确答案：A。纠正休克同时手术

解析：异位妊娠的治疗原则以手术治疗为主，应该妇女同时存在出血性休克，故应在抗休克同时进行手术，选A。掌握“异位妊娠”知识点。